肌功能整塑分为
A. 单次整塑和多次整塑
B. 简单整塑和复杂整塑
C. 直接整塑和间接整塑
D. 主动整塑和被动整塑
E. 一次整塑和二次整塑

正确答案：D。主动整塑和被动整塑

解析：肌功能整塑有主动整塑和被动整塑两种，均要求患者口周肌放松，并与术者密切配合。掌握“局部义齿的印模和模型”知识点。